可摘局部义齿按照义齿对所承受力的支持方式分类的话在临床上最常用的形式是
A. 铸造支架式可摘局部义齿
B. 牙支持式可摘局部义齿
C. 钢丝弯制式可摘局部义齿
D. 混合支持式可摘局部义齿
E. 黏膜支持式可摘局部义齿

正确答案：D。混合支持式可摘局部义齿

解析：可摘局部义齿按照义齿对所承受力的支持方式分类分为牙支持式义齿、黏膜支持式义齿和混合支持式义齿，混合支持式义齿的修复效果介于牙支持式义齿和黏膜支持式义齿之间，适用于各类牙列缺损，尤其是游离端缺失牙的病例，此为临床上最常用的形式。掌握“局部义齿类型，肯氏分类及模型观测”知识点。